以下不符合《非处方药专有标识管理规定（暂行）》的表述是
A. 非处方药药品标签、使用说明书、内包装、外包装上必须印有非处方药专有标识
B. 未印有非处方药专有标识的非处方药药品一律不能出厂
C. 使用非处方药专有标识时，必须按照国家食品药品监督管理局公布的坐标比例和色标要求使用
D. 非处方药专有标识图案分为红色和绿色
E. 红色专有标识用于乙类非处方药品，绿色专有标识用于甲类非处方药品

正确答案：E。红色专有标识用于乙类非处方药品，绿色专有标识用于甲类非处方药品

解析：本题考查非处方药专有标识。非处方药专有标识图案分为红色和绿色（D对），红色专有标识用于甲类非处方药品，绿色专有标识用于乙类非处方药品和用作指南性标志（E错，为本题正确答案）。非处方药药品标签、使用说明书、内包装、外包装上必须印有非处方药专有标识（A对）。未印有非处方药专有标识的非处方药药品一律不能出厂（B对）。使用非处方药专有标识时，必须按照国家食品药品监督管理局公布的坐标比例和色标要求使用（C对）。